女性，28岁，已婚，妊娠14周。因消瘦、乏力、多食、心悸3个月就诊。查体：皮温升高，手震颤，实验室检查TSH降低。当临床及实验室检查确诊为Graves病后，本例病人应选择哪项治疗
A. 丙基硫氧嘧啶治疗
B. 他巴唑治疗
C. 他巴唑治疗+心得安治疗
D. 过氯酸钾治疗
E. 碳酸钾治疗

正确答案：C。他巴唑治疗+心得安治疗

解析：治疗甲亢的抗甲状腺药：丙硫氧嘧啶、他巴唑等。另β肾上腺能受体阻滞剂：普萘洛尔（心得安）是内科治疗的另一重要药物。普萘洛尔不仅可作为β受体阻滞剂用于交感神经兴奋综合征的治疗，而且还有阻断T4转换成T3的作用。对改善症状疗效显著，故答案选择他巴唑治疗+心得安治疗（C对）。丙基硫氧嘧啶（PTU）及他巴唑（MMI）治疗（抗甲状腺药物治疗）是甲亢治疗基础，但是单纯ATD治疗的治愈率仅有40%左右，复发率高达50%~60%（AB错）。该患者无低钾症状，无须过氯酸钾治疗和碳酸钾治疗（DE错）。